结核分枝杆菌的代时为
A. 15～18小时
B. 15～20小时
C. 18～20小时
D. 18～24小时
E. 16～20小时

正确答案：C。18～20小时